WHO提出的健康治理关键领域不包括
A. 提供相关情报信息
B. 确保惩罚机制的建立
C. 制定战略发展方向
D. 建立联盟和伙伴关系
E. 明确治理工具的实施

正确答案：B。确保惩罚机制的建立

解析：本题考查WHO提出的健康治理关键领域。WHO提出的健康治理关键领域包括：①提供相关情报信息（A对）；②制定战略发展方向（C对）；③确保治理工具的实施（E对），如授权、建立奖惩机制等；④建立联盟和伙伴关系（D对）；⑤确保政策目标与组织结构和文化相一致；⑥确保问责机制的建立。确保惩罚机制的建立（B错，为本题正确答案）不是WHO提出的健康治理关键领域。